应用炭疽减毒活疫苗进行皮上划痕接种，其免疫力可持续
A. 一年
B. 三年
C. 五年
D. 十年
E. 永久

正确答案：A。一年

解析：应用炭疽减毒活疫苗皮上划痕接种，免疫力可持续一年。接种对象是疫区皮革和毛纺业职工、牧民、屠宰牲畜人员、兽医等。掌握“动物源性细菌”知识点。